下列哪项属于非感染性发热的疾病
A. 肺结核
B. 肺炎
C. 急性肾盂肾炎
D. 伤寒
E. 血清病

正确答案：E。血清病

解析：发热的原因很多，临床上可分为感染性与非感染性两大类。感染性发热包括：各种病原体如病毒、细菌、支原体、立克次体等引起的感染，肺结核（A错）、肺炎（B错）、急性肾盂肾炎（C错）、伤寒（D错）均属于感染性发热。非感染性发热包括：（1）血液病：如白血病、淋巴瘤、恶性组织细胞病等；（2）结缔组织疾病：如系统性红斑狼疮、皮肌炎、硬皮病、类风湿性关节炎和结节性多动脉炎等；（3）变态反应性疾病：如风湿热、药物热、血清病（E对）、溶血反应等；（4）内分泌代谢性疾病：如甲状腺功能亢进等；（5）血栓及栓塞疾病：如心肌梗死等；（6）颅内疾病：如脑出血等；（7）皮肤病变：如广泛性皮炎；（8）恶性肿瘤等。